患者，男，30岁。高热、寒战2天，胸痛，伴咳嗽，痰中带血。听诊：右肺中部可闻及湿啰音。应首先考虑的是
A. 急性支气管炎
B. 肺炎
C. 肺结核
D. 肺癌
E. 支气管哮喘

正确答案：B。肺炎

解析：患者青年男性，高热、寒战（提示肺部有感染）2天，胸痛，伴咳嗽，痰中带血。听诊：右肺中部可闻及湿啰音，应首先考虑的是肺炎（B对）。急性支气管炎（P17）（A错）起病较急，可有发热，常出现咳嗽和咳痰症状。肺结核（P43）（C错）多有中毒症状，如午后低热、盗汗、疲乏无力、体重减轻等。肺癌（P78）（D错）常发生于有长期大量吸烟史的老年人，多伴有咳嗽、咯血、气短、发热和体重下降等症状。支气管哮喘（P30）（E错）典型症状为发作性伴有哮鸣音的呼气性呼吸困难。